未婚青年，原发性闭经，第二性征发育正常，孕激素试验（-），下一步应作的检查
A. FSH、LH、PRL放免测定
B. 垂体兴奋试验
C. 雌激素试验
D. 基础体温测定
E. 宫颈黏液结晶检查

正确答案：C。雌激素试验

解析：未婚青年，原发性闭经，第二性征发育正常，孕激素试验（-），下一步应作的检查是雌激素试验（C对），阳性，提示子宫内膜功能正常，可排除子宫性闭经；阴性，可诊断为子宫性闭经。FSH、LH、PRL放免测定（A错）要求雌孕激素药物至少两周后进行。垂体兴奋试验（B错）用于了解垂体对 GnRH 的反应性，基础体温测定（D错）是诊断无排卵性月经最常用的手段。宫颈黏液结晶检查（E错）根据羊齿植物叶状结晶的出现与否判断有无排卵，目前已经很少应用。